省级药品监督管理部门制定的《中药饮片炮制规范》属于
A. 企业内控标准
B. 企业参考标准
C. 法定的标准
D. 行业自律标准
E. 强制性标准

正确答案：C、E。法定的标准；强制性标准

解析：本题考查《中药饮片炮制规范》。省级药品监督管理部门制定的《中药饮片炮制规范》属于法定的标准（C对）、强制性标准（E对）。药品标准分为法定标准和非法定标准两种。法定标准是包括中国药典在内的国家药品标准和经国务院药品监督管理部门核准的药品质量标准，法定标准属于强制性标准。中药饮片，有国家标准的，必须按照国家药品标准炮制，国家药品标准没有规定的，才可以按照省级药品标准炮制。